关于新生隐球菌的特点，哪一项是错误的
A. 多数是外源性感染
B. 主要经消化道传播
C. 菌体外有肥厚的荚膜
D. 主要存在土壤和鸽粪中
E. 最易侵犯中枢神经系统

正确答案：B。主要经消化道传播

解析：新生隐球菌一般为外源性感染，主要的入侵途径是呼吸道。大多数感染者症状不明显，且能自愈。但新生隐球菌也可以从肺部经血行播散至其他部位，最易侵犯中枢神经系统，主要引起慢性脑膜炎，死亡率高，尚可播散至皮肤、黏膜、骨和内脏器官等。掌握“真菌概述及主要病原性真菌”知识点。